某女，38岁。自觉咽中不适，如有物梗塞，胸闷，经前乳房胀痛，舌苔白腻，脉弦滑。辨证为痰气互结证。所谓“证”是指
A. 症状表现
B. 病理概括
C. 诊断方法
D. 疾病名称
E. 疾病过程

正确答案：B。病理概括

解析：本题考查的是症、证、病的概念。所谓“证”是指病理概括（B对）。症，指疾病的外在表现，即症状（A错）。病，即疾病的简称（D错），指有特定的致病因素、发病规律和病机演变的异常生命过程（E错），具有特定的症状和体征。所谓“证”，是机体在疾病发展过程中某一阶段的病机概括，包括病变的部位、原因、性质以及邪正关系，能够反映出疾病发展过程中某一阶段的病机变化的本质，因而它比症状能更全面、更深刻、更准确地揭示出疾病的发展过程和本质。诊断方法（C错）即四诊，是诊断疾病的四种基本方法。